《中国药典》规定，质量控制成分为异嗪皮啶和迷迭香酸的中药是
A. 肿节风
B. 连翘
C. 秦皮
D. 五味子
E. 厚朴

正确答案：A。肿节风

解析：本题考查的是肿节风的化学成分。《中国药典》规定，质量控制成分为异嗪皮啶和迷迭香酸的中药是肿节风（A对）。肿节风主要含有酚类、鞣质、黄酮苷、香豆素和内酯类化合物。其中香豆素类主要包括异嗪皮啶、东莨菪内酯等。《中国药典》采用高效液相色谱法测定药材中异嗪皮啶和迷迭香酸含量，其中异嗪皮啶含量不得少于0.020%，迷迭香酸含量不得少于0.020%。连翘（B错）中的木脂素类成分多为双环氧木脂素及木脂内酯，《中国药典》以挥发油、连翘苷和连翘酯苷A为指标成分进行含量测定，要求青翘的挥发油含量不得少于2.0%（ml/g），青翘的连翘酯苷A含量不得少于3.5%，老翘含连翘酯苷A不得少于0.25%；对连翘苷含量要求不得少于0.15%。秦皮（C错）的原植物主要有两种，即木犀科植物大叶白蜡树及白蜡树，大叶白蜡树皮中主要含七叶内酯（秦皮乙素）和七叶苷（秦皮甲素），而白蜡树皮中主要含白蜡素和七叶内酯以及白蜡树苷。《中国药典》采用高效液相色谱法并规定本品按干燥品计，含秦皮甲素、秦皮乙素的总量不得少于1.0%。五味子（D错）中含木脂素较多，约为5%，近年来从其果实中分得了一系列联苯环辛烯型木质素。《中国药典》采用高效液相色谱法测定药材中五味子醇甲的含量，要求不得少于0.40%。厚朴（E错）中主要化学成分为木脂素类化合物，包括厚朴酚以及和厚朴酚等，《中国药典》采用高效液相色谱法测定药材中厚朴酚与和厚朴酚含量，两者总含量不得少于2.0%。